可作为人免疫缺陷病毒（HIV）受体的表面分子是
A. CD20
B. CD3
C. CD4
D. CD21
E. CD8

正确答案：C。CD4

解析：HIV主要侵犯宿主的CD4⁺T细胞，HIV通过其外膜的糖蛋白gp120与靶细胞膜表面CD4（C对BE错）分子结合，引起靶细胞的一系列改变，使病毒核心进入靶细胞。CD20（A错）、CD21（D错）为B细胞表面分子，HIV不侵犯B细胞。